影响社会支持的因素有
A. 人际关系、社会制度
B. 社会制度、社会网络
C. 人际关系、社会网络
D. 文化因素
E. 人际关系、社会网络、社会凝聚力

正确答案：E。人际关系、社会网络、社会凝聚力